属于潴留性囊肿的是
A. 皮脂腺囊肿
B. 皮样囊肿
C. 鳃裂囊肿
D. 表皮样囊肿
E. 甲状舌管囊肿

正确答案：A。皮脂腺囊肿

解析：本题考查口腔颌面部囊肿。属于潴留性囊肿的是皮脂腺囊肿（A对）。1.皮脂腺囊肿主要为由皮脂腺排泄管阻塞，皮脂腺囊状上皮被逐渐增多的内容物膨胀而形成的潴留性囊肿。2.皮样囊肿（B错）或表皮样囊肿（D错）为胚胎发育时期遗留于组织中的上皮细胞发展而形成囊肿；后者也可以由于损伤、手术使上皮细胞植入而形成。皮样囊肿囊壁较厚，由皮肤和皮肤附件所构成。囊腔内有脱落的上皮细胞、皮脂腺、汗腺和毛发等结构，中医称为“发瘤”。囊壁中无皮肤附件者，则为表皮样囊肿。3.鳃裂囊肿（C错）属于鳃裂畸形的一种。4.如甲状舌管不消失时，由残存上皮分泌物聚积可形成先天性甲状舌管囊肿（E错）。